男，40岁，因剧烈腹痛2小时，急诊入院。入院时，心电图显示心房纤颤。查体，腹部平坦，较软，直肠指诊无粘液血便。下列对于确诊最有意义的检查是
A. 腹部X线平片
B. 腹部超声检查
C. 腹部CT
D. 腹部动脉造影
E. 钡剂灌肠造影

正确答案：D。腹部动脉造影

解析：青年男性患者，腹部剧痛2小时，查体腹部平坦、较软，心电图显示心房纤颤（提示有动脉栓塞的可能），结合患者病史、体查和心电图检查，应考虑为肠系膜上动脉栓塞。为明确诊断，最有意义的检查是腹部动脉造影（D对）。腹部动脉造影可清晰的显示出血管栓塞的部位，并可同时给予血管扩张剂等治疗，提高栓塞病变治疗后缺血肠管的成活率。腹部X线平片（A错）可显示受累小肠、结肠轻度或中度扩张胀气，但不能明确有无动脉栓塞。腹部超声检查（B错）、腹部CT（C错）、钡剂灌肠造影（E错）均不能确诊肠系膜动脉栓塞。